男，40岁。因腹胀乏力纳差3天来诊。10年前体检发现HBsAg阳性，HBeAg阳性，ALT正常，口服中药断续治疗，有长期大量饮酒史。家中母亲及2个兄弟均为乙肝患者。查体：神志清楚，面色晦暗，无明显黄染，肝肋下未触及，脾肋下3cm。腹水征（+）。实验室检查：ALT50U/L，HBVDNA2×10⁵/ml。最重要的治疗药物是
A. 核苷（酸）类似物
B. 胸腺肽
C. 丹参
D. 甘草酸制剂
E. 干扰素

正确答案：A。核苷（酸）类似物

解析：40岁男性患者，腹胀乏力纳差3天（慢性肝炎一般表现），10年前体检发现HBsAg阳性，HBeAg阳性，ALT正常（乙肝病史），口服中药断续治疗，有长期大量饮酒史，家中母亲及2个兄弟均为乙肝患者（乙肝家族史）；查体：神志清楚，面色晦暗，无明显黄染，肝肋下未触及，脾肋下3cm。腹水征（+）（慢性肝炎临床表现）；实验室检查：ALT50U/L（正常参考值0～40U/L），HBV DNA2×10⁵拷贝/ml（﹥10⁵拷贝/ml），根据患者的病史、临床表现和实验室检查，患者为慢性乙型肝炎，且已达失代偿期，最重要的治疗是抗病毒治疗，包括干扰素、核苷类似物和其他抗病毒药物。该例患者腹水征（+），已有失代偿性肝硬化表现，故不宜应用干扰素（E错）；核苷（酸）类似物（A对）为重要的抗病毒治疗药物。胸腺肽（B错）有免疫调节的作用。丹参（C错）是改善和恢复肝功的退黄药物，并能抗纤维化。甘草酸制剂（D错）是改善和恢复肝功的降酶药，有降低转氨酶的作用。